患者，女，35岁，在不知怀孕的情况下服用诺氟沙星胶囊。经询问，获知其服药时间距末次月经时间是20天。该用药行为对胎儿可能造成的影响是
A. 骨骼发育异常
B. 流产或发育成正常胚胎
C. 牙齿色素沉着
D. 腭裂
E. 耳聋

正确答案：B。流产或发育成正常胚胎

解析：本题考查妊娠期妇女用药。该用药行为对胎儿可能造成的影响是流产或发育成正常胚胎（B对）。妊娠早期（妊娠13周末以前），细胞增殖早期大约为受精后18天左右，此阶段，胚胎对药物无选择性的表现，其结果为胚胎死亡、流产或存活发育成正常个体。妊娠3～5周，服用叶酸拮抗剂可导致颅面部畸形、腭裂（D错）。妊娠5个月后用四环素可使婴儿牙齿黄染（C错），骨骼发育异常（A错）。链霉素可导致耳聋（E错）。